有关变构调节（或变构酶）的叙述，哪项不正确
A. 催化部位与别构部位位于同一亚基
B. 都含有一个以上的亚基
C. 动力学曲线呈s形曲线
D. 变构调节可有效地和及时地适应环境的变化
E. 该调节可调节整个代谢通路

正确答案：A。催化部位与别构部位位于同一亚基